男，75岁，咳嗽、咳痰，入院检查，发现右肺门靠上一5cm×4cm大小肿物，该肿物最可能压迫的部位是
A. 副半奇静脉
B. 右头臂静脉
C. 右锁骨下静脉
D. 半奇静脉
E. 奇静脉

正确答案：E。奇静脉

解析：肺门有奇静脉经过，肺门处的肿物最可能压迫奇静脉。（E对）。